某成人每日摄入总能量达到需要，碳水化合物占其总能量的30％，脂肪占40％，蛋白质占30％，为达到平衡膳食要求，应提高摄入的食物类别是
A. 谷类
B. 肉类
C. 蛋类
D. 蔬菜
E. 水果

正确答案：A。谷类